新生儿Apgar评分指标不包括
A. 体温
B. 呼吸
C. 心率
D. 肌张力
E. 皮肤颜色

正确答案：A。体温

解析：Apgar评分内容包括皮肤颜色（C对）、心率（E对）、对刺激的反应、肌张力（B对）和呼吸（D对）五项指标，不包括体温（A错，为本题正确答案）。